如下哪项为胃热炽盛型鼻衄之主证
A. 头痛眩晕
B. 目赤
C. 烦躁易怒
D. 脉弦数
E. 口干臭秽

正确答案：E。口干臭秽

解析：胃热炽盛证之鼻衄的临床表现为鼻衄，或兼齿衄，血色鲜红，口渴欲饮，鼻干，口干臭秽，烦躁，便秘，舌红，苔黄，脉数。证型强调胃热，胃热则胃火上炎，口干臭秽的症状比较突出（E对）。